女，20岁。面色苍白、乏力、心悸1周。实验室检查：Hb65g/L，WBC9.4×10⁹/L，plt212×10⁹/L，网织红细胞0.12，Coombs试验阳性。该患者首选的治疗措施是
A. 输注红细胞
B. 应用环孢素A
C. 应用硫唑嘌呤
D. 脾切除
E. 应用糖皮质激素

正确答案：E。应用糖皮质激素

解析：患者青年女性，面色苍白、乏力、心悸1周（贫血的表现），实验室检查：Hb65g/L（成年女性110～150g/L），提示贫血，WBC9.4×10⁹/L（正常4～10×10⁹/L），plt212×10⁹/L（正常100～300×10⁹/L），网织红细胞0.12（正常值0.005～0.015）增高，提示骨髓红系代偿性增生（符合溶血性贫血的变化），Coombs试验阳性（温抗体型自身免疫性溶血性贫血的特异性试验），故患者诊断为温抗体型自身免疫性溶血性贫血可能性大，治疗首选糖皮质激素（E对）。输注红细胞（P559）（A错）为贫血较重者的对症处理，应输入洗涤红细胞，且速度应缓慢；脾切除（P558）（D错）为温抗体型自身免疫性溶血性贫血的二线治疗，用于糖皮质激素无效或不能耐受者；免疫抑制剂（P559）如环孢素A（B错）、硫唑嘌呤（C错）等用于糖皮质激素和脾切除都不能缓解者或有脾切除禁忌证者，不是首选治疗。